切面皮部墨绿色或棕褐色，木部灰黄色或黄褐色，可见放射状排列的导管束纹，形成层部位多有深色环的饮片是
A. 续断
B. 莪术
C. 川芎
D. 羌活
E. 生地黄

正确答案：A。续断

解析：本题考查的是续断的性状鉴别。切面皮部墨绿色或棕褐色，木部灰黄色或黄褐色，可见放射状排列的导管束纹，形成层部位多有深色环的饮片是续断（A对）。续断：【性状鉴别】饮片续断片呈类圆形或椭圆形的厚片。外表皮灰褐色至黄褐色，有纵皱。切面皮部墨绿色或棕褐色，木部灰黄色或黄褐色，可见放射状排列的导管束纹，形成层部位多有深色环。气微，味苦、微甜而涩。莪术（B错）：【性状鉴别】饮片呈类圆形或椭圆形厚片。外表皮灰黄色或灰棕色，有时可见环节或须根痕，切面黄绿色、黄棕色或棕褐色。内皮层环纹明显，散在“筋脉”小点。气微香，味微苦而辛。川芎（C错）：【性状鉴别】饮片为不规则厚片，外表皮黄褐色或褐色，有皱缩纹。横切片切面黄白色或灰黄色，散有黄棕色小油点，可见明显波状环纹或多角形纹理。纵切片边缘不整齐，呈蝴蝶状，习称“蝴蝶片”，切面灰白色或黄白色，散有黄棕色小油点。质坚实，气浓香，味苦、辛、微甜。羌活（D错）：【性状鉴别】饮片为类圆形、不规则横切或斜切片。表皮棕褐色至黑褐色，切面外侧棕褐色，木部黄白色，有的可见放射状纹理。体轻，质脆。气香，味微苦而辛。生地黄（E错）：【性状鉴别】饮片呈类圆形或不规则的厚片，外表皮棕黑色或棕灰色，极皱缩，具不规则的横曲纹，切面棕黄色至黑色或乌黑色，有光泽，具黏性。气微，味微甜。